后牙（牙合）运循环中生物力学杠杆作用，可形成
A. 第Ⅰ类杠杆
B. 第Ⅱ类杠杆
C. 第Ⅲ类杠杆
D. 第Ⅳ类杠杆
E. 第Ⅴ类杠杆

正确答案：B。第Ⅱ类杠杆

解析：在后牙（牙合）运循环中非工作侧髁突虽向工作侧移动，但仍为翼外肌、颞肌、舌骨上下肌群所稳定，作为支点，工作侧的升颌肌群以咬肌与翼内肌收缩为力点，研磨食物处为重点，构成第Ⅱ类杠杆。掌握“咀嚼过程、类型，咀嚼周期及生物力”知识点。